下列关于儿少卫生学的描述，错误的是
A. 儿少卫生学是预防医学的重要组成部分
B. 是保护和促进青少年身心健康的科学
C. 儿少卫生学的研究对象是学龄儿童
D. 当代儿少卫生学正从以往单纯的医学背景向儿少与学校卫生学转移
E. 当代儿少卫生高度重视中小学生

正确答案：C。儿少卫生学的研究对象是学龄儿童

解析：儿少卫生学的研究对象为中小学生